公共卫生从业人员在传染病防控中应遵循的伦理要求不正确的是
A. 履行早发现、早诊断、早治疗的道德责任
B. 积极开展传染病的防控
C. 认真做好传染病的检测和报告
D. 尊重科学，有奉献精神
E. 尊重传染病患者的人格和权利

正确答案：A。履行早发现、早诊断、早治疗的道德责任

解析：对于公共卫生从业人员来说，在传染病防控中应遵循以下伦理要求：①积极开展传染病的防控，对广大群众的健康负责；②认真做好传染病的监测和报告，履行其道德和法律责任；③尊重科学，具有奉献精神；④尊重传染病患者的人格和权利。A项属于防控慢性非传染性疾病的卫生从业人员应遵循的伦理要求。掌握“公共卫生工作伦理要求”知识点。